最能反映医患关系性质的表述是一种
A. 陌生人关系
B. 信托关系
C. 主动-被动关系
D. 类似父子的关系
E. 商品关系

正确答案：B。信托关系

解析：我国当代著名肝胆外科专家吴孟超（公元1922年—）曾把医师治病比喻为背病人过河。这个生动的比喻形象地揭示了医患关系的本质—信托关系（B对）。医师和病人在医学知识上存在着信息不对称的现象。在诊疗中，基于对医师的信任，病人将健康托付给医师。医师则运用自己的专业知识和技能，努力维护病人的最佳利益，在病人的支持和配合下，尽最大的能力医治疾病，减少痛苦，给病人尽可能多的人文关怀和帮助。信任在先，托付在后。医患之间只有相互尊重、相互信任，才能共同战胜疾病。